参与转录过程的酶是
A. DNA连接酶
B. 核酸内切酶
C. 引物酶
D. DNA聚合酶
E. RNA聚合酶

正确答案：E。RNA聚合酶

解析：生物体以DNA为模板合成RNA的过程称为转录，参与转录过程的酶是RNA聚合酶（E对）。DNA连接酶（A错）连接复制中产生的单链缺口（P239），引物酶（C错）催化RNA引物生成（P238），DNA聚合酶（D错）催化脱氧核糖核苷酸间的聚合（P235），均为DNA复制过程的酶。核酸内切酶（B错）为核酸的水解酶（P196）。